结肠癌增高的是
A. 碱性磷酸酶
B. 癌胚抗原
C. 乳酸脱氢酶
D. α-酸性糖蛋白
E. α-胚胎抗原

正确答案：B。癌胚抗原

解析：癌胚抗原（B对）对消化道肿瘤如结肠癌的诊断有一定的意义。碱性磷酸酶（A错）增高见于骨肿瘤。乳酸脱氢酶（C错）增高见于恶性肿瘤、肝炎、肝硬化、肾脏疾病、心肌梗死等。α-酸性糖蛋白（D错）增高见于肺癌。α-胚胎抗原（E错）增高见于肝癌。